男性，25岁。急非淋M₂型经DA方案后部分缓解，近日自觉左下肢疼痛，腰椎～5椎旁压痛（+），直腿抬高试验（+），应如何治疗
A. 腰穿脑脊液检查，鞘内注射MTX
B. 细胞因子，如IL-2或IFN-ɑ
C. 大剂量治疗
D. 放疗
E. 以上选项均不正确

正确答案：A。腰穿脑脊液检查，鞘内注射MTX

解析：患者青年男性，急非淋M₂型部分缓解后，出现左下肢疼痛，腰椎4～5椎旁压痛（+），直腿抬高试验（+）（腰椎椎骨、外周神经受损的表现），怀疑侵犯脊椎，应给予腰椎穿刺脑脊液检查明确有无中枢神经系统侵犯，并给予鞘内注射甲氨喋呤（MTX）预防治疗（A对）。多数化疗药难以通过血脑屏障，不能有效杀灭隐藏在中枢神经系统的白血病细胞，大剂量治疗（C错）全身副作用大且效果不好；细胞因子，如IL-2或IFN-α（B错）不是中枢神经系统白血病的防治措施；放疗（P575）（D错）仅作为CNSL发生时的挽救治疗，不具有预防作用。